初孕妇，27岁。妊娠37周，晚10时突然出现无痛性阴道较多量流血入院。查体：BP110/70mmHg。子宫软，枕左前位，胎心164次/分。目前恰当的处理措施是
A. 剖宫产
B. 器械助娩
C. 等待自然分娩
D. 缩宫素引产
E. 人工破膜引产

正确答案：A。剖宫产

解析：青年初产妇，妊娠37周（妊娠28周及以后为妊娠晚期）突然出现无痛性阴道较多量流血（前置胎盘的典型症状为妊娠晚期或临产时，发生无诱因、无痛性反复阴道流血），该孕妇可诊断为前置胎盘。该孕妇子宫软，尚无临产迹象，不符合阴道分娩的指征（BCDE错），恰当的处理措施是行剖宫产（A对）。